《温热论》中指出，温病邪留三焦，治用
A. 达原饮
B. 小柴胡汤
C. 茯苓皮汤
D. 温胆汤
E. 大柴胡汤

正确答案：D。温胆汤

解析：三焦主气机升降出入，通行水道。湿热之邪久羁气分，既不外解，也不内陷营血分，可留于三焦。邪留三焦，则湿阻热郁，气机郁滞，水道不利，见寒热起伏、胸满腹胀、溲短、苔腻等症。治宜分消走泄，宣通三焦，用杏、朴、苓或者温胆汤（D对），此即“分消上下之势”。